除另有规定外，需要检查水分的丸剂有
A. 糊丸
B. 滴丸
C. 蜜丸
D. 蜡丸
E. 浓缩丸

正确答案：A、C、E。糊丸；蜜丸；浓缩丸

解析：本题考查的是丸剂的水分要求。除另有规定外，需要检查水分的丸剂有糊丸（A对）、蜜丸（C对）与浓缩丸（E对）。除另有规定外，蜜丸和浓缩蜜丸中所含水分不得过15.0%；水蜜丸和浓缩水蜜丸不得过12.0%；水丸、糊丸、浓缩水丸不得过9.0%。蜡丸（D错）不检查水分。滴丸（B错）的水分检查，2022年考试指南未明确说明。